关于火热内生机理的叙述，错的是
A. 气有余便是火
B. 邪欲化火
C. 五志过极化火
D. 精亏血少，阴虚阳亢
E. 外感暑热阳邪

正确答案：E。外感暑热阳邪

解析：火热内生，又称“内火”或“内热”，是由于阳盛有余，或阴虚阳亢，或由于气血的郁滞，或由于病邪的郁结而产生的火热内扰，机能亢奋的病理变化。火热内生包括气过盛化火即阳气偏盛，呈现病理性的功能亢进，导致各种火证的病机，即“气有余便是火”（A对）、邪郁化火（B对），五志过极化（C对）及阴虚火旺（D对）。外感暑热阳邪属于外感病（E错，为本题正确答案）。